某村卫生室私自从“不法药贩”处购入药品用于患者的治疗，险些造成患者死亡。事发后，经有关部门调查检测，认定该药品为假药。该认定依据的事实是
A. 药品标签未标明有效期
B. 药品擅自添加着色剂
C. 直接接触药品的包装材料未经批准
D. 药品超过有效期
E. 药品所含成分与国家药品标准规定的成分不符

正确答案：E。药品所含成分与国家药品标准规定的成分不符

解析：依照《药品管理法》，药品所含成分与国家药品标准规定的成分不符（E对）的药品按假药论处，某村卫生室私自从“不法药贩”处购入的药品属于假药。劣药，是指药品成分含量不符合国家药品标准规定的药品。《药品管理法》规定，有下列情形之一的药品按劣药论处：①药品标签未标明有效期（A错）的；②不注明或者更改生产批号的；③药品超过有效期（D错）的；④直接接触药品的包装材料未经批准（C错）的；⑤药品擅自添加着色剂（B错）、防腐剂、香料、矫味剂及辅料的；⑥其他不符合药品标准规定的（P184-P185）。